子宫内膜癌病理分期ⅢB期是指
A. 癌侵犯宫颈间质
B. 癌累及宫颈黏膜腺体
C. 癌侵犯肌层＞1/2
D. 癌侵犯浆膜和（或）附件
E. 癌累及阴道上1/3段

正确答案：E。癌累及阴道上1/3段

解析：现行（FIGO，2009）的子宫内膜癌手术分期标准，①Ⅰ期 肿瘤局限于子宫体；ⅠA 肿瘤浸润深度＜1/2肌层；ⅠB 肿瘤浸润深度≥1/2肌层（C错）。②Ⅱ期 肿瘤侵犯宫颈间质（A错），但无宫体外蔓延。③Ⅲ期 肿瘤局部和（或）区域扩散；ⅢA 肿瘤累及浆膜层（D错）和（或）附件；ⅢB 阴道和（或）宫旁受累（E对）；ⅢC 盆腔淋巴结和（或）腹主动脉旁淋巴结转移，ⅢC1 盆腔淋巴结阳性，ⅢC2 腹主动脉旁淋巴结阳性伴（或不伴）盆腔淋巴结阳性。④Ⅳ期 肿瘤侵及膀胱和（或）直肠粘膜和（或）远处转移；ⅣA 肿瘤侵及膀胱和（或）直肠粘膜；ⅣB 远处转移，包括腹腔内和（或）腹股沟淋巴结转移。按以前的分期标准Ⅱ期可分为ⅡA累及宫颈黏膜腺体（B错）和ⅡB侵犯宫颈间质。